旅店业的供水水质应符合
A. 游泳池水水质卫生标准
B. 生活饮用水卫生标准
C. 地面水卫生标准
D. 水源水卫生标准
E. 工业用水卫生标准

正确答案：B。生活饮用水卫生标准

解析：本题考查旅店业的供水水质应符合的标准。旅店业的供水水质应符合《生活饮用水卫生标准》规定（B对ACDE错）。